男性，40岁。因发热，便秘，食欲不振12天入院。查体：肝大，肋下lcm，软，脾肋下一指。血常规WBC2.7×10⁹/L，中性粒细胞52%，淋巴细胞44%，血清ALT120U/L，肥达反应：“O”1：160，“H”1：160。为进一步确定诊断，需做什么检查
A. 便常规
B. 尿常规
C. 骨髓检查
D. 血细菌培养
E. 肝脏穿刺治疗

正确答案：D。血细菌培养

解析：该患者发热，便秘，食欲不振12天，白细胞3.2×1012/L（成人正常参考值4～10×10⁹/L）减少，肥大试验阳性，故该患者最可能的诊断为伤寒。在病程第1~2周，血培养（D对）阳性率最高，可用于确诊，阴性则可考虑作骨髓培养。便常规（A错）、尿常规（B错）均属于常规检查，不用于进一步确诊伤寒，肝脏穿刺治疗（E错）多用于诊断肝脏疾病。